既可屈肘又可使前臂旋后的肌是
A. 肱桡肌
B. 肱肌
C. 肱二头肌
D. 肘肌
E. 旋后肌

正确答案：C。肱二头肌

解析：肱桡肌（A错）屈肘关节。肱肌（B错）屈肘关节。肱二头肌（C对）屈肘关节，使前臂旋后，协助屈肩关节。旋后肌（E错）使前臂旋后